正确的是
A. 肋膈窦是肋胸膜与膈胸膜的返折处
B. 肋膈窦是肋胸膜与纵隔胸膜的返折处
C. 肋膈窦呈环形,是平卧位时胸膜腔最低点
D. 肋纵隔窦是肋胸膜与纵隔胸膜的返折处,仅左侧有
E. 以上都错

正确答案：A。肋膈窦是肋胸膜与膈胸膜的返折处

解析：肋隔隐窝是肋胸膜与膈胸膜的返折处（A对B错）。肋隔隐窝是一个半环形间隙（C错）。肋隔隐窝左、右各一（D错）。